《艾滋病防治条例》规定采集或者使用人体（）等的，应当进行艾滋病检测
A. 人体组织
B. 人体器官
C. 人体细胞
D. 人体骨髓
E. 以上都是

正确答案：E。以上都是

解析：采集或者使用人体组织、器官、细胞、骨髓等的，应当进行艾滋病检测；未经艾滋病检测或者艾滋病检测阳性的，不得采集或者使用。但是，用于艾滋病防治科研、教学的除外。掌握“艾滋病的预防与控制、治疗与法律责任”知识点。